女孩，会用勺子吃饭，能双脚跳，会翻书，会说2～3个字的短句，最可能的年龄是
A. 2岁
B. 4岁
C. 1.5岁
D. 3.5岁
E. 3岁

正确答案：A。2岁

解析：小儿神经精神发育进程：1、粗、细动作上：会用勺子吃饭，能双脚跳；2、语言上：3、会说2-3个字的短句；适应周围人的能力与行为上：会翻书（A对）。